连于肺动脉干分叉处稍左侧与主动脉弓下缘处的结构是
A. 胚胎时期动脉导管闭锁后的遗迹
B. 化学感受器
C. 压力感受器
D. 胚胎时期卵黄囊闭锁后的遗迹
E. 胚胎时期输尿管闭锁后的遗迹

正确答案：A。胚胎时期动脉导管闭锁后的遗迹

解析：胚胎时期动脉导管闭锁后的遗迹（A对）为连于肺动脉干分叉处稍左侧与主动脉弓下缘处的结构，称动脉韧带。